维生素K₁应检查的杂质有
A. 甲萘醌
B. 差向四环素
C. 阿扑吗啡
D. 地西泮
E. 有关物质

正确答案：A、E。甲萘醌；有关物质

解析：本题考查维生素K₁的杂质检查。甲萘醌为维生素K₁合成的起始物，可能引入到产品中，需要进行检查。维生素K₁侧链上碳原子之间为双键，为反式构型，可能存在顺式异构体，需要检查有关物质（E对）。